某人拟准备在市区开办一文化娱乐场所，在经营前必须到当地卫生机构申办有关证件后方可营业。此证件名为
A. 从业人员健康合格证
B. 从业人员业务培训合格证
C. 公共场所卫生许可证
D. 公共场所防火安全合格证
E. 公共场所卫生标准合格证

正确答案：C。公共场所卫生许可证

解析：本题考查公共场所卫生许可证。卫生许可证是卫生行政部门在开业之前，依据经营者申请进行预防性卫生监督之后，认为所经营的项目符合卫生标准和要求而制发的卫生许可证明书。公共场所卫生许可证（C对ABDE错）是公共场所经营的必备文件，是由当地卫生机构签发的，可以证明该公共场所经营的项目是符合当地卫生标准和要求的许可证书。